关于第一磨牙解剖特点的叙述，下列说法正确的是
A. 上颌第一磨牙向舌侧倾斜
B. 下颌第一磨牙是下牙弓中体积最大的牙齿
C. 下颌第一磨牙一般为近远中颊根与舌根
D. 上颌第一磨牙一般为近远中双根
E. 斜嵴是下颌第一磨牙的解剖特征

正确答案：B。下颌第一磨牙是下牙弓中体积最大的牙齿

解析：本题考查第一磨牙的解剖特点。下颌第一磨牙是下牙弓中体积最大的牙齿（B对）。上颌第一磨牙颊面与舌面大小相近，牙冠较直（A错），近中舌尖三角嵴与远中颊尖三角嵴斜形相连形成斜嵴，是上颌第一磨牙的解剖特征（E错），牙根由三根组成，分别为近中颊根、远中颊根和舌根（D错）。下颌第一磨牙牙根为扁而厚的双根（C错），根干较短，近中根比远中根稍大。